维生素D的生理功能主要表现为
A. 促进骨与软骨的骨化
B. 提高小肠对钙、磷的吸收和转运
C. 调节血钙平衡
D. 促进肾脏对钙、磷的重吸收
E. 以上都是

正确答案：E。以上都是